女，58岁。乏力、低热1个月。查体：双侧颈部、腋窝和腹股沟均可触及肿大淋巴结，最大者直径2cm、质韧、无触痛，胸骨无压痛，肝肋下未触及，脾肋下3cm。实验室检查：Hb76g/L，WBC5.2×10⁹/L，Plt123×10⁹/L，网织红细胞0.14，coombs试验（+），尿胆红素（—），尿胆原（+++）。针对该患者的贫血首选的治疗药物是
A. 泼尼松
B. 促红细胞生成素
C. 环磷酰胺
D. 环孢素A
E. 丙种球蛋白

正确答案：A。泼尼松

解析：患者Hb76g／L（成年女性Hb正常值110～150g/L）减低，网织红细胞0.14（正常0.005～0.015）增高，Coombs试验（+），尿胆红素（-），尿胆原（+++）提示抗人球蛋白试验阳性的溶血性贫血，属于温抗体型自身免疫性溶血性贫血（P558），针对该患者的贫血首选的治疗药物是糖皮质激素泼尼松治疗。促红细胞生成素（P540）（B错）常用于肾性贫血、慢性病贫血；环磷酰胺（P559）（C错）和环孢素A（P559）（D错）是免疫抑制剂，仅用于糖皮质激素不能缓解及脾切除禁忌者；丙种球蛋白（P559）（E错）针对自身免疫性溶血性贫血治疗有一定疗效，但不持久。